具有两个磺酰胺基团，临床上常与其他抗高血压药合用的药物是
A. 氢氯噻嗪
B. 氯噻酮
C. 乙酰唑胺
D. 螺内酯
E. 阿米洛利

正确答案：A。氢氯噻嗪